用制备衍生物测熔点的方法鉴别盐酸丁卡因，加入的试液是
A. 三硝基苯酚
B. 硫酸铜
C. 硫氰酸铵
D. 三氯化铁
E. 亚硝基铁氰化钠

正确答案：C。硫氰酸铵